引起心输出量减少的因素是
A. 甲状腺功能减退
B. 运动
C. 贫血
D. 焦虑
E. 妊娠

正确答案：A。甲状腺功能减退

解析：甲状腺激素对心脏的活动有显著的影响，可使心率增快（正性变时效应）、心肌收缩力增强（正性变力效应）、心输出量和心肌耗氧量增加。反之，甲状腺功能减退，心输出量减少（A对）。而情绪激动，如焦虑（D错）及运动（B错）时，机体交感神经兴奋，神经末梢释放去甲肾上腺素作用于心肌细胞，产生正性变时、正性变力及正性变传导作用，综合提高心输出量（P128）。贫血（C错）、妊娠（E错）时，心脏容量负荷增加，心输出量增加（九版内科学P164）。